对于慢性闭锁性牙髓炎，医生应注意的是
A. 疼痛发生的时间及程度
B. 病史+体征
C. 注意与可复性牙髓炎及深龋鉴别
D. 必要时可行诊断性治疗
E. 以上都是

正确答案：E。以上都是

解析：本题考查慢性闭锁性牙髓炎。慢性闭锁性牙髓炎无明显的自发痛，而有自发痛的病史（AB对），对温度测验为敏感，也可为迟热测引起的迟缓性疼痛，洞内探诊患牙感觉迟钝，去净腐质后无肉眼可见的穿髓孔。可复性牙髓炎和深龋也无自发痛，深龋冷热刺激入洞后出现敏感症状，可复性牙髓炎冷热刺激尤其是冷刺激可出现一过性敏感，而慢性闭锁性牙髓炎几乎所有患者都由长期的冷、热刺激痛史，多有叩痛或叩痛不适感，深龋和可复性牙髓炎无叩痛，因此可以鉴别（C对），如果难以鉴别，用氧化锌丁香油安抚观察，观察期间有无自发痛的症状再进行诊断（D对）。（ABCD均对，故E为本题的正确答案）。